对患高血压合并痛风者不宜选用
A. 福辛普利
B. 利血平
C. 尼索地平
D. 氢氯噻嗪
E. 特拉唑嗪

正确答案：D。氢氯噻嗪

解析：本题考查氢氯噻嗪。对患高血压合并痛风者不宜选用氢氯噻嗪（D对）。氢氯噻嗪为噻嗪类利尿药，痛风患者禁用。福辛普利（A错）为ACEI类降压药，禁用于双侧肾动脉狭窄、高钾血症及妊娠期。利血平（B错）为去甲肾上腺素能神经末梢阻滞药，禁用于活动型胃溃疡、溃疡性结肠炎、抑郁症，尤其是有自杀倾向的抑郁症。尼索地平（C错）为二氢吡啶类钙通道阻滞剂，但心动过速与心力衰竭患者应慎用。特拉唑嗪（E错）为选择性α₁受体阻滞剂，体位性低血压者禁用，心力衰竭者慎用。